某社区共有5～6岁儿童230人，根据WHO制定的2000年口腔健康目标，该年龄段无龋儿童至少达到
A. 92人
B. 138人
C. 115人
D. 69人
E. 161人

正确答案：C。115人

解析：本题考查2000年口腔健康目标。某社区共有5～6岁儿童230人，根据WHO制定的2000年口腔健康目标，该年龄段无龋儿童至少达到115人（C对）。根据WHO制定的2000年口腔健康目标，我国5-6岁年龄组乳牙患龋率为50%，故无龋率=100%-50%=50%=该年龄组全口无龋的人数/受检年龄段人数×100%,故该年龄段无龋儿童至少达到115人。